预防慢性偏头痛的药物是
A. 托吡酯
B. 卡马西平
C. 乙琥胺
D. 左乙拉西坦
E. 氯硝西泮

正确答案：A。托吡酯

解析：偏头痛的药物性治疗分为发作期治疗和预防性治疗。预防性治疗药物包括β肾上腺素能受体阻滞剂、抗癫痫药、抗抑郁药和5-HT受体拮抗剂。托吡酯（A对）是预防慢性偏头痛的预防性治疗药物，也可作为新型抗癫痫药物，用于难治性部分性发作及继发全面强直-阵挛发作的附加或单药治疗（P315）。卡马西平（B错）是部分性发作的首选，可加重失神和阵挛性发作。乙琥胺（C错）仅用于癫痫单纯失神发作。左乙拉西坦（D错）为新型抗癫痫药，用于治疗部分性发作伴或不伴继发全面强直-阵挛发作的治疗。氯硝西泮（E错）常用作辅助用药。